男性，2岁。1个月来食欲减退，消瘦伴乏力，低热、盗汗、干咳2个月，易怒。体检：颈部可见数个肿大淋巴结，肝肋下1.5cm，结核菌素试验（++）。进行治疗药物选择
A. 异烟肼
B. 异烟肼+利福平
C. 利福平+链霉素
D. 链霉素+乙胺丁醇
E. 利福平

正确答案：B。异烟肼+利福平

解析：结核病治疗的化疗方案原则（P218）为早期、规则、全程、联合（AE错）、适量。异烟肼+利福平（P219）（B对）化疗方案是常用方案。